具有行气、消食、回乳的功效，临床常用于产后回乳的饮片是
A. 炒六神曲
B. 麦芽
C. 炒麦芽
D. 麸炒六神曲
E. 焦六神曲

正确答案：C。炒麦芽

解析：本题考查的是麦芽的炮制作用。具有行气、消食、回乳的功效，临床常用于产后回乳的饮片是炒麦芽（C对）。麦芽：【炮制作用】麦芽（B错）味甘，性平。归脾、胃经。具有消食和胃、疏肝通乳的功能。用于消化不良，乳汁淤积，乳癖。①炒麦芽偏温而气香，具有行气、消食、回乳之功。②焦麦芽性偏温而味微甘、微涩，增强了消食化滞、止泻的作用。炒六神曲（A错）、麸炒六神曲（D错）与焦六神曲（E错）为六神曲的炮制品。六神曲：【炮制作用】六神曲味甘、辛，性温。入脾、胃经。①生六神曲健脾开胃，并有发散作用。②炒神曲健脾悦胃功能增强，发散作用减少。③麸炒六神曲具有甘香气，以醒脾和胃为主。用于食积不化，脘腹胀满，不思饮食，肠鸣泄泻。④焦六神曲消食化积力强，以治食积泄泻为主。